造成帕金森病的主要原因是
A. 红核病变
B. 底丘脑核病变
C. 苍白球病变
D. 新纹状体病变
E. 黑质细胞变性

正确答案：E。黑质细胞变性

解析：造成帕金森病的主要原因是黑质细胞变性（E对），黑质变性使黑质输出至纹状体的多巴胺减少，导致背侧丘脑向大脑运动皮质发放的兴奋性冲动减少，出现帕金森病的表现如肌肉强直、运动受限和减少并出现震颤。底丘脑核病变（B错）导致同侧苍白球的抑制状态解除，使对侧肢体出现大幅度颤搐。